参与替代途径激活补体的物质是
A. IgG
B. IgM
C. IgD
D. LPS
E. MBL

正确答案：D。LPS

解析：细菌脂多糖（LPS）、肽聚糖、酵母多糖和凝聚的IgA、IgE等主要激活物，在B因子、D因子和被解素参与下，直接由C3b与激活结合后启动补体旁路激活途径。掌握“补体的概念，激活途径及调节”知识点。